慢性肾衰竭引起高血压的机制包括
A. 肾素-血管紧张素系统活性减弱
B. 钠、水排出增多
C. 扩血管物质生成增多
D. 肾合成PGE2、PGA2减少
E. 心排血量减少

正确答案：D。肾合成PGE2、PGA2减少

解析：慢性肾衰竭引起高血压的机制包括：1.钠水猪留；2.肾素分泌增多；3.肾脏产生激肤、PGE2、PGA2及Angl-7等降压物质减少（D对）。